开具西药、中成药处方，每一种药品应当另起一行，每张处方不得超过
A. 2种药品
B. 3种药品
C. 5种药品
D. 6种药品
E. 7种药品方

正确答案：C。5种药品

解析：开具西药、中成药处方，每一种药品应当另起一行，每张处方不得超过5种药品。掌握“处方管理概述及一般规定、处方权”知识点。